在气雾剂的处方中，可作为潜溶剂的辅料是
A. F12
B. 丙二醇
C. 吐温80
D. 蜂蜡
E. 维生素C

正确答案：B。丙二醇

解析：本题考查气雾剂的附加剂。丙二醇（B对）可做气雾剂的潜溶剂，除此之外，乙醇、丙二醇、甘油和聚乙二醇等皆可作潜溶剂；F12（A错）为气雾剂抛射剂；吐温80（C错）可作为O/W型乳剂的乳化剂；维生素C（E错）可作为抗氧剂；蜂蜡（D错）可作为W/O型乳化剂。